慢性职业中毒早期多出现的临床表现是
A. 类神经症
B. 周围神经炎
C. 中毒性脑病
D. 震颤
E. 中毒性精神病

正确答案：A。类神经症

解析：本题考查慢性职业中毒早期临床表现。慢性职业中毒早期常为轻度可逆的功能性改变，继续接触则可演变成严重的器质性病变，故应及早诊断和处理。慢性中毒的常见症状较多，如类神经症（A对BCDE错）、精神症状、周围神经病变、白细胞降低、接触性皮炎，慢性肝、肾病变等，应对病人进行及时合理的对症治疗。